羟甲唑啉缓解鼻黏膜充血肿胀的作用机制是
A. 拮抗鼻黏膜血管肾上腺素α₁受体
B. 激动鼻黏膜血管肾上腺素α₁受体
C. 激动鼻黏膜血管组胺H₁受体
D. 拮抗鼻黏膜血管组胺H₁受体
E. 直接收缩鼻黏膜血管

正确答案：B。激动鼻黏膜血管肾上腺素α₁受体

解析：本题考查羟甲唑啉的作用机制。羟甲唑啉为肾上腺素α₁受体激动药，能够激动鼻黏膜血管肾上腺素α₁受体（B对），使外周血管收缩，缓解鼻黏膜充血肿胀引起的鼻塞，减少鼻腔分泌物或鼻出血。